四环素牙主要着色的硬组织是
A. 牙釉质
B. 牙本质
C. 牙骨质
D. 牙槽骨
E. 牙周膜

正确答案：B。牙本质

解析：牙本质磷灰石晶体小，总表面积比釉质磷灰石晶体大，因而牙本质吸收四环素的量较釉质为多，造成牙本质为主要着色硬组织。掌握“四环素牙齿”知识点。